关于开闭运动中的颞下颌关节运动不正确的描述为
A. 当小开颌时，髁状突仅转动
B. 当小开颌时，运动轴心在下颌孔
C. 当小开颌时，运动发生在下腔
D. 当大开颌时，髁状突不仅转动而且滑动
E. 当大开颌时，运动轴心在髁状突和下颌孔附近

正确答案：B。当小开颌时，运动轴心在下颌孔

解析：本题考查颞下颌关节的运动。关于开闭运动中的颞下颌关节运动不正确的描述为当小开颌时，运动轴心在下颌孔（B错，为本题的正确答案）。当小开口运动时，两侧髁状突仅做转动（A对），运动轴心在髁突，活动发生在关节下腔（C对）。当大开口运动时，髁状突不仅转动而且滑动（D对），运动轴心在髁状突和下颌孔附近（E对）。